不属于人格倾向性的是
A. 需要
B. 动机
C. 能力
D. 兴趣
E. 信念

正确答案：C。能力

解析：人格（个性）包括：人格倾向性（需要、动机、兴趣、信念等）、人格特征（能力、气质、性格）、自我意识（自我认识、自我体验、自我调控）。掌握“心理学概述”知识点。